产生大肠菌素的质粒是
A. F因子
B. R质粒
C. Vi质粒
D. Col质粒
E. r决定因子

正确答案：D。Col质粒

解析：细菌素质粒（编码各种细菌产生的细菌素）；Col质粒编码大肠埃希菌产生大肠菌素。掌握“细菌遗传变异的物质基础及机制”知识点。